有关空．回肠的描述，错误的是
A. 空、回肠活动度较大
B. 孤立淋巴滤泡在空、回肠均可见到
C. 集合淋巴滤泡只见于空肠的粘膜内
D. 空肠肠壁较厚、管径较大、血管较丰富、粘膜皱襞高而密
E. 无

正确答案：C。集合淋巴滤泡只见于空肠的粘膜内

解析：限制空、回肠的肠系膜根和肠缘长度相差很多，导致空、回肠活动度较大(A对)，孤立淋巴滤泡存在于空、回肠的黏膜内(B对)，集合淋巴滤泡多见于回肠下部(C错，为本题正确答案)，空肠腔粗壁后，血管丰富，黏膜形成的皱襞高而且密集(D对)。